治疗上肢瘫痪，痉挛，前臂神经痛，应首选
A. 肩髃
B. 臂中
C. 曲池
D. 阳陵泉
E. 合谷

正确答案：B。臂中

解析：臂中穴为经外奇穴，在腕掌横纹与肘横纹中点，两筋之间，主治：上肢瘫痪、痉挛，前臂神经痛，癔病（B对）。肩髃穴主治：①肩臂挛痛、上肢不遂等肩、上肢病证；②瘾疹。不能治疗前臂神经痛（A错）。曲池同样可治疗手臂痹痛、上肢不遂等上肢病证，但其在肘部，未言其可治前臂神经痛（C错）。阳陵泉虽为筋会，但属胆经且在下肢，非首选（D错）。合谷主治：①头痛、目赤肿痛、齿痛、耳聋等头面五官诸疾；②发热恶寒等外感病证，热病无汗或多汗；③经闭、滞产等妇产科病证（E错）